某患儿因高烧就医，诊断为重症流感，医生对患儿进行治疗的同时建议与患儿有密切接触的家属预防服用奥司他韦。关于奥司他韦预防用药的说法正确的是
A. 应于密切接触流感患儿的2天以内预防服用，每日一次每次75mg
B. 应于密切接触流感患儿的2天以内预防服用，每日一次每次150mg
C. 应于密切接触流感患儿的2天以内预防服用，毎日两次每次75mg
D. 应于密切接触流感患儿的3天以内预防服用，每日两次每次150mg
E. 应于密切接触流感患儿的3天以内预防服用，每日三次每次50mg

正确答案：A。应于密切接触流感患儿的2天以内预防服用，每日一次每次75mg

解析：本题考查奥司他韦。关于奥司他韦预防用药的说法正确的是应于密切接触流感患儿的2天以内预防服用，每日一次每次75mg（A对）。用于与流感患者密切接触后的流感预防时的推荐剂量为一次75mg，一日1次，至少7日，应在密切接触后2日内开始用药。